治疗肠梗阻肠腑热结证应首选
A. 复方大承气汤
B. 小承气汤
C. 增液承气汤
D. 甘遂通结汤
E. 麻子仁丸

正确答案：A。复方大承气汤

解析：肠梗阻肠腑热结证治疗应活血清热，通里攻下，方药用复方大承气汤（A对）。小承气汤（B错）治疗伤寒阳明证，谵语便硬，潮热而喘者。增液承气汤（C错）用于大便不通，热结阴亏者。甘遂通结汤（D错）适用于肠梗阻水结湿阻证。麻子仁丸（E错）主要用于肠胃燥热，津液不足，大便干结，小便频数者。